关于软脑膜的描述，哪项错误
A. 薄而富有血管
B. 覆盖于脑的表面
C. 深入到脑的沟裂内
D. 参与构成脉络丛
E. 位于蛛网膜与硬脑膜之间

正确答案：E。位于蛛网膜与硬脑膜之间

解析：软脑膜薄而富有血管（A对）和神经，覆盖于脑的表面（B对）并伸入沟裂内（C对），在某些部位，脉络组织的血管反复分支成丛，连同其表面的软脑膜和室管膜上皮一起突入脑室，形成脉络丛（D对），软脑膜位于脑蛛网膜内侧（E错，为本题正确答案）。